高血压伴有糖尿病及痛风者，不宜选用的药物是
A. 硝苯地平
B. 哌唑嗪
C. 利血平
D. 氢氯噻嗪
E. 普萘洛尔

正确答案：D。氢氯噻嗪

解析：氢氯噻嗪的不良反应有：对糖代谢及脂质代谢出现不良影响，如高血糖、高血脂，故高血压患者合并有糖尿病或高脂血症者慎用；并可使血浆肾素活性增高，激活RAAS而不利于降压，可与β受体阻断药等降低肾素活性的药物合用；还可以致高尿酸血症、高氮质血症，故痛风患者和肾功能减退者等慎用（D对）。